关于镇咳药作用强度的比较，正确的是
A. 喷托维林＞苯丙哌林＞可待因
B. 可待因＞苯丙哌林＞喷托维林
C. 苯丙哌林＞喷托维林＞可待因
D. 苯丙哌林＞可待因＞喷托维林
E. 喷托维林＞可待因＞苯丙哌林

正确答案：D。苯丙哌林＞可待因＞喷托维林

解析：本题考查镇咳药的作用强度。镇咳药作用强度的比较是苯丙哌林＞可待因＞喷托维林（D对）。喷托维林为人工合成的非成瘾性中枢性镇咳药，镇咳作用强度约为可待因的1/3。苯丙哌林可阻断肺-胸膜的牵张感受器产生的肺迷走神经反射，并具有罂粟样平滑肌解痉作用。镇咳作用较强，为可待因的2～4倍。所以镇咳作用强度苯丙哌林＞可待因＞喷托维林。